与情绪形成有关的3个要素是
A. 环境、心境、生理变化
B. 情景、心境、条件反射
C. 情景、刺激、生理过程
D. 认知、反应、结果评价
E. 情景、认知、生理变化

正确答案：E。情景、认知、生理变化